下列哪项试验不属于流行病学实验研究
A. 观察性试验
B. 社区试验
C. 现场试验
D. 临床试验

正确答案：A。观察性试验

解析：本题考查实验流行病学的分类。实验流行病学根据研究目的和研究对象的不同，通常把实验流行病学研究分为临床试验（D对）、现场试验（C对）和社区试验（B对）和类实验四类。实验流行病学不包括观察性试验（A错，为本题正确答案）。